在养生防病时，对阴盛体质的宜忌是
A. 宜寒忌温
B. 宜凉忌热
C. 宜平忌消
D. 宜泻忌补
E. 宜温忌寒

正确答案：E。宜温忌寒

解析：本题考查的是体质学说的应用。在养生防病时，对阴盛体质的宜温忌寒（E对）。体质学说可用于指导养生防病：对于不同的体质，应当采用不同的养生方法。例如，体质强壮者应注意预防疾病。因为疾病可以损伤人体，使体质下降，防病可维持体质，加强锻炼身体，可保持体质的强壮；而体质虚弱者除了要预防疾病外，还要注意饮食起居，避免劳逸过度，适当锻炼，促使体质增强。对于不同类型的体质，还应注意生活起居和饮食方面的宜忌。例如，阳盛体质宜凉忌热（B错），阴盛体质宜温忌寒。